流行病学研究的基本方法是
A. 病原微生物的分离鉴定
B. 先进的仪器诊断技术
C. 调查分析
D. 精确的检测手段

正确答案：C。调查分析

解析：本题考查流行病学研究的基本方法。当流行病学工作遇到病因未明疾病的调查时，常采取流行病学调查分析（C对ABD错）的方法，再配合临床检查和检验，从寻找危险因素入手，从而找到这些疾病发病的原因。